慢阻肺低浓度氧疗的氧流量为
A. 1.0-2.0L/min
B. 1.0-2.5L/min
C. 1.0-1.5L/min
D. 0.5-2.0L/min
E. 0.5-1.0L/min

正确答案：A。1.0-2.0L/min

解析：长期家庭氧疗对慢阻肺并发慢性呼吸衰竭者可提高生活质量和生存率，对血流动力学、运动能力和精神状态均会产生有益的影响。长期家庭氧疗的使用指征为：①PaO2≤55mmHg或SaO2≤88%，有或没有高碳酸血症。②PaO255～60mmHg,或SaO2＜89%,并有肺动脉高压、右心衰竭或红细胞增多症（血细胞比容＞0.55)。一般用鼻导管吸氧，氧流量为1.0～2.0L/min（A对）,吸氧时间＞15h/d。目的是使病人在海平面、静息状态下，达到PaO2≥60mmHg和（或）使SaO2升至90%以上。